PSI指数的设计原理是
A. 评分加权征询法
B. 幂函数型
C. 兼顾最高和平均分指数
D. 密切值法
E. 分段线性函数型

正确答案：E。分段线性函数型

解析：本题考查PSI指数的设计原理。PSI即污染物标准指数，其设计原理是分段线性函数型（E对ABCD错）。这类指数的各分指数与其实测浓度呈分段线性函数关系，指数的表示也以各分指数分别表示或选择最高的表示，并赋予其健康效应含义和应采取的措施。